关于盖髓术适应证的叙述，有哪一项是错误的
A. 深龋引起的可复性牙髓炎
B. 龋齿备洞时意外穿髓
C. 深龋去腐未净露髓
D. 年轻人恒牙的急性可复性牙髓炎
E. 以上无一条正确

正确答案：C。深龋去腐未净露髓

解析：本题考查盖髓术的适应证。深龋去腐未净露髓（C错，为本题的正确答案），牙髓有可能已被感染，不宜行直接盖髓术，应进行根管治疗。深龋引起的可复性牙髓炎（A对），牙髓通常处于充血状态，经盖髓术后牙髓能够恢复健康，是盖髓术的适应证。龋齿备洞时意外穿髓（B对），露髓孔小于1mm时，直接盖髓术可保护牙髓不被感染，是盖髓术的适应证。年轻人恒牙的急性可复性牙髓炎（D对）经盖髓术可安抚受激惹的牙髓，使牙髓恢复健康状态，是盖髓术的适应证。